易致肝风内动的邪气是
A. 寒
B. 燥
C. 湿
D. 暑
E. 火

正确答案：E。火

解析：肝风内动证是指临床出现眩晕欲仆，震颤，抽搐等症状的病证。多由肝肾阴液精血亏虚，血不养筋，肝阴不能制约肝阳而肝阳亢奋无制所致。火热之邪侵犯人体，燔灼津液，劫伤肝阴，筋脉失养失润，易引起肝风内动的病证（E对）。寒邪致病（A错）特点是寒为阴邪，易伤阳气；寒性凝滞凝滞，易使气血津液凝结、经脉阻滞；寒性收引。燥邪致病（B错）特点是燥性干涩，易伤津液；燥易伤肺。湿邪致病（C错）特点是湿为阴邪，易伤阳气；湿性重浊，常出现以沉重感及附着难移为特征的临床表现；湿性黏滞，易阻气机；湿性趋下，易袭阴位。暑邪致病（D错）特点是暑为阳邪，其性炎热；暑性升散，易扰心神，易伤津耗气升；暑多挟湿：暑邪致病，多挟湿邪为患。